能促进促胰液素分泌的胃液成分是
A. 内因子
B. 碳酸氢盐
C. 盐酸
D. 胃蛋白酶
E. 黏液

正确答案：C。盐酸

解析：盐酸（C对）是促进促胰液素分泌的最强的刺激因素。内因子（A错）可以促进维生素B₁₂的吸收。HCO₃⁻（B错）的主要作用是与胃黏膜表面的黏液（E错）联合形成黏液-碳酸氢盐屏障，可以有效地保护胃黏膜免受胃内盐酸和胃蛋白酶的损伤。胃蛋白酶（D错）能正反馈激活胃液的自身分泌。